按照《互联网药品信息服务管理暂行规定》，从事互联网药品信息服务，除应当符合《互联网信息服务管理办法》规定的要求外，还应当具备的条件之一是
A. 必须具有《药品经营许可证》
B. 必须获得GSP认证证书
C. 有保证药品信息来源合法、真实、安全的管理措施
D. 必须具有执业药师
E. 有四名以上了解药品管理法律、法规和药品知识，并经考核认可的专业人员

正确答案：C。有保证药品信息来源合法、真实、安全的管理措施

解析：本题考查互联网药品信息服务。按照《互联网药品信息服务管理暂行规定》，从事互联网药品信息服务，除应当符合《互联网信息服务管理办法》规定的要求外，还应当具备的条件之一是有保证药品信息来源合法、真实、安全的管理措施（C对）。申请提供互联网药品信息服务，除应当符合《互联网信息服务管理办法》规定的要求外，还应当具备下列条件：①互联网药品信息服务的提供者应当为依法设立的企事业单位或者其他组织；②具有与开展互联网药品信息服务活动相适应的专业人员、设施及相关制度；③有2名以上熟悉药品、医疗器械管理法律、法规和药品、医疗器械专业知识，或者依法经资格认定的药学、医疗器械技术人员。